明尼苏达多相人格调查表（MMPI）最初是根据什么需要编制的
A. 心理学应用
B. 职业选择
C. 临床医学
D. 人类学研究
E. 精神病临床

正确答案：E。精神病临床